患者接受顺铂化疗时，药师应重点监测的不良反应是
A. 心脏毒性
B. 肝脏毒性
C. 肾脏毒性
D. 肾纤维化
E. 过敏反应

正确答案：C。肾脏毒性

解析：本题考查药物不良反应。顺铂化疗的主要毒副作用为耳毒性、肾毒性（C对）及神经毒性。蒽环类抗生素可引起心脏毒性（A错）。阿糖胞苷的主要毒副作用有肝损害（B错）、高尿酸血症。门冬酰胺酶、紫杉醇、甲基苄肼等易引起过敏反应（E错）。肾纤维化（D错）在最新版大纲中未明确要求。